生存分析中的效应变量或因变量为
A. 生存时间
B. 生存率
C. 生存结局
D. 生存率和生存结局
E. 生存时间和生存结局

正确答案：E。生存时间和生存结局

解析：本题考查生存分析中的效应变量或因变量。生存分析中的效应变量或因变量通常为生存时间和生存结局（E对ABCD错）。